胃经循行未至的部位是
A. 口
B. 目
C. 鼻
D. 膈
E. 下齿

正确答案：E。下齿

解析：该题主要考察经络的循行。足阳明胃经起于鼻翼旁（C对）（迎香穴），挟鼻上行，旁行入目内眦（B对），入上齿中，还出挟口，环唇（A对），其支脉沿喉咙入缺盆，下横膈（D对）。循行未至的部位是下齿（E错，为本题正确答案）。